丙炔苯丙胺属于
A. 抗胆碱药
B. 多巴胺受体激动剂
C. 复方左旋多巴
D. 单胺氧化酶β抑制剂
E. 儿茶酚-氧-甲基转移酶抑制剂

正确答案：D。单胺氧化酶β抑制剂

解析：司来吉兰又名丙炔苯丙胺，是MAO-B（单胺氧化酶B）抑制剂（D对），体内的MAO有存在于肠道的MAO-A型和主要存在中枢的MAO-B，丙炔苯丙胺可选择性抑制中枢神经系统MAO-B，迅速通过脑屏障，降低脑内DA降解代谢，使多巴胺浓度增加，有效时间延长，是左旋多巴的增效剂。抗胆碱药（A错）（P135）是苯海索治疗帕金森的作用机制。多巴胺受体激动剂（B错）（P134）是溴隐亭治疗帕金森病的作用机制。复方左旋多巴（C错）属于多巴胺前体药。儿茶酚-氧-甲基转移酶抑制剂（E错）（P133）是卡巴比妥治疗帕金森病的机制。